患者脘腹痞塞不舒，胸膈满闷，头晕目眩，身重困倦，呕恶纳呆，口淡不渴，舌苔白厚腻，脉沉滑。治疗应首选
A. 保和丸
B. 泻心汤
C. 二陈平胃汤
D. 越鞠丸
E. 补中益气汤

正确答案：C。二陈平胃汤

解析：保和丸为痞满饮食停滞证的选方，功能消食导滞，和胃降逆（A错）。泻心汤常合连朴饮治疗痞满湿热阻胃证，功能泻热破结（B错）。题中患者以脘腹痞塞不舒，胸膈满闷为主症，故诊断为痞满，脘腹痞塞不舒，胸膈满闷为脾不运化，痰湿内生，壅塞中焦所致，痰湿上蒙清窍，故头晕目眩，脾失健运，运化水湿功能失常，湿性重着，故身重困倦，水湿内停，浊阴不降，故呕恶纳呆，口淡不渴，舌苔白厚腻，脉沉滑为脾虚失运，痰湿内阻之象，故辨为痰湿中阻证，治宜除湿化痰，理气和中，方选二陈平胃汤（C对）。越鞠丸常合枳术丸治疗痞满肝胃不和证，功能疏肝行气解郁（D错）。补中益气汤为痞满脾胃虚弱证的选方，功能健脾益气，升举清阳（E错）。